阳盛血热证月经先期的首选方是
A. 丹栀逍遥散
B. 两地汤
C. 清热固经汤
D. 保阴煎
E. 清经散

正确答案：E。清经散

解析：月经先期阳盛血热证，治法清热凉血调经 用清经散（E对）。月经先期肝郁血热证，治法疏肝清热，凉血调经用丹栀逍遥散（A错）。月经先期阴虚血热证，治法养阴清热调经，用两地汤（B错）。清热固经汤主治崩漏血实热证（C错）。保阴煎主治胎漏、胎动不安之血热证（D错）。